具有分节段基因、分类上属于正黏病毒科的病毒是
A. 流感病毒
B. 风疹病毒
C. 轮状病毒
D. 副流感病毒
E. 呼肠病毒

正确答案：A。流感病毒